根据中医理论，“症”“证”“病”含义不同，下列表述中属于“证”的是
A. 胸痹
B. 心悸
C. 气虚血瘀
D. 胸胁胀满
E. 胸痛彻背

正确答案：C。气虚血瘀

解析：本题考查的是症、证、病的概念。根据中医理论，“症”“证”“病”含义不同，下列表述中属于“证”的是气虚血瘀（C对）。症，指疾病的外在表现，即症状。病，即疾病的简称，指有特定的致病因素、发病规律和病机演变的异常生命过程，具有特定的症状和体征。所谓“证”，是机体在疾病发展过程中某一阶段的病机概括，包括病变的部位、原因、性质以及邪正关系，能够反映出疾病发展过程中某一阶段的病机变化的本质，因而它比症状能更全面、更深刻、更准确地揭示出疾病的发展过程和本质。胸痹气虚血瘀证：【症状】胸痛隐隐，遇劳则发，神疲乏力，气短懒言，心悸自汗。舌胖有齿痕，色淡暗，苔薄白，脉弱而涩，或结、代。【治法】益气活血，通脉止痛。【方剂应用】基础方剂为补阳还五汤（当归、川芎、黄芪、桃仁、红花、地龙、赤芍）加减。【中成药应用】常用中成药有芪参益气滴丸、参桂胶囊、心力丸、活心丸。胸痹（A错）属于疾病、胸痛彻背（E错）属于胸痹的症状。胸痹是指以胸部闷痛，甚则胸痛彻背，短气、喘息不得卧为主症的疾病，轻者仅感胸闷如窒，呼吸欠畅，重者则有胸痛，严重者心痛彻背，背痛彻心。西医学的冠心病（心绞痛或心肌梗死）、其他原因引起的心绞痛（如主动脉瓣狭窄、梗阻性肥厚型心肌病）、心包炎以及肺源性心脏病等以上述表现为主者，可参考此内容辨证论治。心悸（B错）属于胸痹寒凝心脉证的症状。胸痹寒凝心脉证：【症状】猝然心痛如绞，心痛彻背，喘不得卧，多因气候骤冷或骤感风寒而发病或加重，伴形寒，甚则手足不温，冷汗自出，胸闷气短，心悸，面色苍白。舌质紫暗，或有瘀斑瘀点，苔薄，脉沉紧或沉细。【治法】辛温散寒，宣通心阳。【方剂应用】基础方剂为枳实薤白桂枝汤（枳实、厚朴、薤白、桂枝、瓜蒌实）合当归四逆汤（当归、桂枝、芍药、细辛、通草、炙甘草、大枣）加减。【中成药应用】常用中成药有宽胸气雾剂、苏合香丸、冠心苏合滴丸、神香苏合丸（庆余救心丸）。胸痛胀满（D错）属于咳嗽痰热郁肺证的症状。咳嗽痰热郁肺证：【症状】咳嗽，气息粗促，或喉中有痰声，痰多，质黏稠色黄，或有腥味，难咳，胸胁胀满，或咳时引痛，面赤，或有身热，口干而黏，欲饮水。舌红，苔黄腻，脉滑数。【治法】清热肃肺，豁痰止咳。【方剂应用】基础方剂为清金化痰汤（黄芩、栀子、桔梗、麦冬、桑白皮、贝母、知母、瓜蒌仁、橘红、茯苓、甘草）加减。【中成药应用】常用中成药有清肺化痰丸、清肺抑火丸、复方鲜竹沥液。